公正不仅指形式上的类似，更强调公正的
A. 作用
B. 内容
C. 基础
D. 特点
E. 意义

正确答案：B。内容